动脉血压升高后，下列心功能评价指标降低的是
A. 每搏输出量
B. 射血分数
C. 心指数
D. 射血量
E. 心脏做功量

正确答案：B。射血分数

解析：动脉血压升高，可使心输出量暂时减少，但是通过自身调节可使心输出量很快得到恢复，使一侧心室一次的射血量（D错）即每搏输出量（A错）保持不变。心指数=心输出量/体表面积（m2），心输出量不变，体表面积不变，所以心指数（C错）不变。射血分数=每搏输出量/心室舒张末期容积，由于动脉血压升高，代偿作用使心腔变大，所以射血分数（B对）降低。当动脉血压升高时，为克服加大的射血阻力，心肌必须增加其收缩强度才能使搏出量保持不变，因而心脏做功量（E错）必定增加。